《中国药典》规定，以东莨菪碱为质量控制成分之一的中药是
A. 防己
B. 雷公藤
C. 洋金花
D. 山豆根
E. 延胡索

正确答案：C。洋金花

解析：本题考查的是含生物碱类化合物的常用中药。《中国药典》规定，以东莨菪碱为质量控制成分之一的中药是洋金花（C对）。洋金花主要化学成分为莨菪烷类生物碱，由莨菪醇类和芳香族有机酸结合生成的一元酯类化合物。主要有莨菪碱（阿托品）、山莨菪碱、东莨菪碱、樟柳碱和N-去甲莨菪碱。《中国药典》以东莨菪碱为指标成分进行含量测定，要求东莨菪碱不得少于0.15%。防己（A错）的有效成分为生物碱，总生物碱含量可达2.3%～5%，其中汉防己甲素（粉防己碱），约为1%，汉防己乙素（防己诺林碱）约为0.5%。《中国药典》以粉防己碱和防己诺林碱为指标成分进行含量测定，对药材要求两者总量不得少于1.6%；对饮片要求两者总量不得少于1.4%。雷公藤（B错）中主要化学成分为雷公藤甲素、雷公藤乙素和雷公藤红素等。山豆根（D错）的主要活性成分为生物碱，这些生物碱大多属于喹喏里西啶类。其中以苦参碱和氧化苦参碱为主，《中国药典》以苦参碱和氧化苦参碱为指标成分进行含量测定要求药材两者总量不得少于0.70%，饮片两者总量不得少于0.60%。延胡索（E错）含有多种苄基异喹啉类生物碱，包括延胡索甲素、延胡索乙素（dl-四氢巴马汀）和去氢延胡索甲素等，这些生物碱的类型为原小檗碱型、原托品碱型、阿朴菲型等六种异喹啉型生物碱，其中多数属原小檗碱型。《中国药典》以延胡索乙素为指标成分进行含量测定，要求含量不得少于0.050%。